按十二经脉的流注次序，肝经向下留注的经脉是
A. 心经
B. 肺经
C. 膀胱经
D. 胆经
E. 三焦经

正确答案：B。肺经

解析：十二经脉流注次序：手太阴肺经→手阳明大肠经→足阳明胃经→足太阴脾经→手少阴心经→手太阳小肠经→足太阳膀胱经→足少阴肾经→手厥阴心包经→手少阳三焦经→足少阳胆经→足厥阴肝经（简便记忆：肺大胃脾心小肠，膀肾包焦胆肝藏）。根据十二经脉流注次序，肝经向下流注于肺经（B对）。